肺热壅盛、喘促气急，治疗宜与平喘药配伍的是
A. 栀子
B. 芦根
C. 石膏
D. 夏枯草
E. 淡竹叶

正确答案：C。石膏

解析：石膏辛寒入肺经，善于清泄肺经实热，治疗邪热壅肺，咳逆喘促，发热口渴者（C对）。栀子（A错）味苦性寒清降，能清泻三焦火邪，泻心火而除烦，为治热病心烦，躁扰不宁的要药。芦根（B错）入肺经，善于清泻肺热，祛痰排脓，用于治疗肺热咳嗽，肺痈吐脓。夏枯草（D错）苦寒降泻，主入肝经，善于清泻肝火以明目。淡竹叶（E错）甘寒，入心经能清心火以除烦，入胃经能泻胃火以止渴。